血管壁异常所致出血的特点是
A. 内脏出血
B. 迟发出血
C. 皮肤黏膜出血
D. 关节腔出血
E. 肌肉出血

正确答案：C。皮肤黏膜出血

解析：血管壁异常所致出血的特点：女性多见，常见皮肤紫癜、皮肤黏膜出血（C对），内脏出血（A错）偶见，关节腔出血（D错）、肌肉出血（E错）罕见。内脏出血（A错）常见于血小板疾病及凝血障碍性疾病；迟发出血（B错）常见于颅脑损伤；关节腔出血（D错）、肌肉出血（E错）常见于凝血障碍性疾病。